在非处方药的遴选原则中疗效确切是指
A. 重金属限量不超过国内或国际公认标准
B. 在一般贮藏条件下，较长时间不会出现变质或影响疗效
C. 包装内有详细通俗易懂的药品说明书
D. 处方合理，功能主治明确，使用者可根据自己症状选择
E. 经过对药理、药性、剂量和使用结果进行综合评价

正确答案：D。处方合理，功能主治明确，使用者可根据自己症状选择

解析：本题考查的是非处方药的遴选原则。在非处方药的遴选原则中疗效确切是指处方合理，功能主治明确，使用者可根据自己症状选择（D对）。非处方药的遴选原则包括：①应用安全。长期使用证实安全性大；无潜在毒性，不易引起蓄积中毒，中药中的重金属限量不超过国内或国外公认标准（A错）；基本无不良反应；不引起依赖性，无“三致”作用；医疗用毒性药品、麻醉药品以及精神药品原则上不能作为非处方药，但个别麻醉药品与少数精神药品可作为“限复方制剂活性成分”使用；组方合理，无不良相互作用，比如中成药组方中无“十八反”“十八畏”等。②疗效确切。药物作用针对性强，功能主治明确；不需要经常调整剂量；连续使用不引起耐药性。③质量稳定。质量可控、性质稳定。制剂稳定，在有效期限内，一般贮藏条件下，较长时间不会出现变质或影响疗效（B错）。④使用方便。不用经过特殊检查和试验即可使用；以口服和外用的常用剂型为主。包装内有详细且通俗易懂的“药品说明书（C错）”，内容包括药品名称、药物组成、功能主治、用法用量、禁忌症、注意事项、不良反应，以及采取的预防处理措施、贮藏、生产日期、生产厂家等。